全口牙中牙体和牙根最长的牙
A. 上颌切牙
B. 下颌尖牙
C. 上颌尖牙
D. 下颌切牙
E. 下颌磨牙

正确答案：C。上颌尖牙

解析：上颌尖牙是全口牙中牙体和牙根最长的牙齿。掌握“上下颌前牙的外形及临床应用解剖”知识点。